链激酶促进纤维蛋白溶解的作用机制是
A. 直接激活纤维蛋白溶酶
B. 直接使纤维蛋白溶酶原转变为纤维蛋白溶酶
C. 直接抑制纤维蛋白溶酶原
D. 与纤溶酶原结合形成SK-纤溶酶原复合物，促进纤溶酶原转变为纤溶酶
E. 改变血栓纤维蛋白构型，易于与纤溶酶原结合，激活纤溶酶原成为纤溶酶

正确答案：D。与纤溶酶原结合形成SK-纤溶酶原复合物，促进纤溶酶原转变为纤溶酶

解析：链激酶的溶栓机制：与纤溶酶原结合形成SK-纤溶酶原复合物，促进纤溶酶原转变为纤溶酶（D对AC错）。尿激酶的溶栓机制：使纤溶酶原从g560-Val561处断裂成纤溶酶（B错）。组织型纤溶酶原激活剂的溶栓机制：使血栓中纤维蛋白发生构型改变，易于与纤溶酶原结合，激活纤溶酶原为纤溶酶（E错）。